具有胸膜摩擦音体征的疾病是
A. 结核性干性胸膜炎
B. 结核性渗出性胸膜炎
C. 肺结核并发气胸
D. 结核性脓胸
E. 金黄色葡萄球菌肺炎

正确答案：A。结核性干性胸膜炎

解析：胸膜摩擦音是由于炎症、纤维素渗出而使正常光滑的胸膜表面变得粗糙时，随着呼吸产生的，因此具有胸膜摩擦音体征的疾病是结核性干性胸膜炎（A对）。